淡黄色处方作为
A. 普通处方
B. 急诊处方
C. 儿科处方
D. 麻醉药品和第一类精神处方
E. 第二类精神药品处方

正确答案：B。急诊处方

解析：本题考查处方。急诊处方（B对）印刷用纸为淡黄色、普通处方（A错）为白色、儿科处方（C错）为淡绿色。麻醉药品和第一类精神药品处方（D错）印刷用纸为淡红色，第二类精神药品处方（E错）为白色。